下列哪项不属于口腔健康促进的任务
A. 制定有效的、有相关部门承诺的政策
B. 确立口腔健康目标
C. 在口腔健康促进行动中协调政府、社会团体和个人的行动
D. 提高公众对口腔健康的认知程度和口腔疾病预防意识
E. 制定危险因素预防政策

正确答案：B。确立口腔健康目标

解析：口腔健康促进的任务主要有以下5个方面：①制定危险因素预防政策，包括：对相关的科学研究给予更多的支持，加强口腔信息监测系统建设，改善各地网络信息连通渠道；②制定有效的、有相关部门承诺的政策，预防有上升趋势的口腔健康高危险因素；③加强国际国内和各级部门间的合作，增强控制口腔危险因素的能力，提高公众对口腔健康的认知程度和口腔疾病预防意识；④在口腔健康促进行动中协调政府、社会团体和个人的行动；⑤组织社区口腔健康促进示范项目，尤其关注社会弱势群体、儿童和老年人。掌握“口腔健康促进”知识点。